具有粘附作用的物质有
A. RNP
B. LTA
C. P蛋白
D. M蛋白
E. NA

正确答案：B。LTA

解析：使细菌在体内定居的菌体表面结构：即普通菌毛（促进细菌吸附及定居作用）和脂磷壁酸（LTA）（与易感细胞表面受体结合，使细菌在体内定居）。掌握“医院感染及细菌的致病性”知识点。